某疾病经过较长时间后其临床表现、死亡率、发病率发生了变化。这种变化属于
A. 疾病的季节性
B. 疾病的长期趋势
C. 疾病的周期性
D. 疾病爆发后的余波
E. 疾病在不同年龄间的分布

正确答案：B。疾病的长期趋势

解析：本题考查长期趋势的概念。长期趋势（B对ACDE错）又称长期变异或长期变动，是指在一个比较长的时间内，通常为几年或几十年，疾病的临床特征、分布状态、流行强度等方面所发生的变化。